甲状腺大部切除后48小时内，需注意最危急的并发症为
A. 喉上神经内侧支损伤
B. 喉返神经单侧损伤
C. 手足抽搐
D. 呼吸困难和窒息
E. 甲状腺危象

正确答案：D。呼吸困难和窒息

解析：甲状腺手术后最危急的并发症是呼吸困难和窒息（D对），多发生在术后48小时内，如不及时发现、处理，则可危及病人生命。喉上神经内侧支损伤（A错）将导致喉部粘膜感觉丧失，进食特别是饮水时，容易误咽发生呛咳，一般经理疗后可自行恢复，不是危急并发症。喉返神经单侧损伤（B错）可引发声音嘶哑，可由健侧声带部分代偿而恢复发音，并非危急并发症。手足抽搐（C错）多由甲状旁腺功能减退导致的低血钙引起，保守治疗无效可行甲状旁腺移植，不是术后最危急的并发症。甲状腺危象（E错）为甲亢术后的严重并发症，表现为高热、脉快，同时合并神经、循环及消化系统严重紊乱，亦需及时处理，但不如呼吸困难危急。